指临近绝经的阶段（内分泌学、生物学及临床特征上出现绝经趋势的迹象）和绝经后1年的是
A. 绝经前期
B. 绝经后期
C. 绝经过渡期
D. 围绝经期
E. 更年期

正确答案：D。围绝经期

解析：本题考查围绝经期的概述。围绝经期指从接近绝经时出现与绝经有关的内分泌和临床表现时起至绝经后1年内的期间（D对）。绝经前期（A错）通常是指末次月经前整个生殖期。绝经后期（B错）指为末次月经后时期。绝经过渡期（C错）是指妇女从生育期走向一生中的最后一次月经的一段过渡时期。更年期（E错）是指妇女从成年进入老年期所必须经过的阶段，是介于生育期和老年期之间的一段时期。